患者，男，30岁，每年春季出现体发性打喷疃、流涕（清水样）、鼻塞以及眼痒、鼻痒、咽痒等症状。主诉“近日鼻部呼吸不畅，影响睡眠”而就诊。目前考虑该患者首选的治疗药物是
A. 对乙酰氨基酚片
B. 布地奈德鼻喷剂
C. 头孢呋辛酯片
D. 奥司他韦胶囊
E. 阿莫西林胶囊

正确答案：B。布地奈德鼻喷剂

解析：本题考查过敏性鼻炎的药物治疗。鼻用糖皮质激素（如布地奈德鼻喷剂）（B对）是过敏性鼻炎的一线治疗药物。其对过敏性鼻炎患者的所有鼻部症状（包括打喷嚏、流鼻涕、鼻痒和鼻塞）均有显著改善作用，是目前治疗过敏性鼻炎最有效的药物。